患者手足厥寒,或腰、股、腿、足、肩臂疼痛,口不渴,舌淡苔白,脉沉细或细而欲绝。选下列何方治疗最佳
A. 四逆汤
B. 四逆散
C. 当归四逆汤
D. 温经汤
E. 九味羌活汤

正确答案：C。当归四逆汤

解析：患者手足厥寒,或腰、股、腿、足、肩臂疼痛,口不渴,舌淡苔白,脉沉细或细而欲绝。本方证由营血虚弱，寒凝经脉，血行不利所致。素体血虚而又经脉受寒，寒邪凝滞，血行不利，阳气不能达于脉四肢末端，营血不能充盈血脉，遂呈手足厥寒、脉细欲绝。治当温经散寒，养血通脉。选当归四逆汤治疗最佳（C对）。四逆汤主治心肾阳衰寒厥证。四肢厥逆，恶寒蜷卧，神衰欲寐，面色苍白，腹痛下利，呕吐不渴，舌苔白滑，脉微细（A错）。四逆散主治阳郁厥逆证。手足不温，或腹痛，或泄利下重，脉弦。肝脾气郁证。协肋胀闷，脘腹疼痛，脉弦等（B错）。温经汤主治冲任虚寒，瘀血阻滞证。漏下不止，或血色暗而有块，淋漓不畅，或月经超前或延后，或逾期不止，或一月再行，或经停不至，而见少腹里急，腹满，傍晚发热，手心烦热，唇口干燥，舌质暗红，脉细而涩。亦治妇人宫冷，久不受孕（D错）。九味羌活汤主治外感风寒湿邪，内有蕴热证。恶寒发热，无汗，头痛项强，肢体酸楚疼痛，口苦微渴，舌苔白或微黄，脉浮（E错）。